青光眼病人的眼压约在22～42mmHg范围，非青光眼病人的眼压约在14～26mmHg范围内，根据这些资料，可以认为：如果将筛检标准值定为26mmHg，可以认为灵敏度与特异度的关系为
A. 灵敏度较好，特异度也较好
B. 灵敏度较差，特异度也较差
C. 灵敏度较好，特异度较差
D. 灵敏度较差，特异度较好
E. 无法判断

正确答案：D。灵敏度较差，特异度较好

解析：本题考查确定连续性测量指标的阳性截断值。青光眼病人的眼压约在22～42mmHg范围，非青光眼病人的眼压约在14～26mmHg范围内，如果将筛检标准值定为26mmHg，则病人不能很好的筛检出来，但能把更多的非病人给筛检出来，即灵敏度较差，特异度较好（D对ABCE错）。